可用于治疗厌氧菌及产ESBL的革兰阴性杆菌感染的药物是
A. 头孢呋辛
B. 头孢他啶
C. 头孢米诺
D. 头孢唑林
E. 头孢曲松

正确答案：C。头孢米诺

解析：本题考查药物的作用。头孢米诺（C对）对大多数超广谱β-内酰胺酶稳定且抗厌氧菌作用强，可用于治疗厌氧菌及产ESBL的革兰阴性杆菌感染。头孢唑林（D错）作用于需氧革兰阳性球菌，仅对少数肠杆菌科细菌有一定的抗菌性。头孢呋辛（A错）对革兰阳性球菌的活性与第一代头孢菌素相仿或略差，对部分肠杆菌科细菌具有抗菌活性。头孢他啶（B错）、头孢曲松（E错）对肠杆菌科细菌有良好的抗菌作用。